下列措施属于疾病第三级预防措施的是
A. 接种疫苗
B. 首诊测高血压
C. 职业防护
D. 合理营养
E. 肿瘤靶向治疗

正确答案：E。肿瘤靶向治疗